甲状腺患侧腺叶大部切除术适用于
A. 甲状腺乳头状癌
B. 青少年原发性甲亢
C. 单纯性弥漫性甲状腺肿
D. 甲状腺高功能腺瘤
E. 桥本病

正确答案：D。甲状腺高功能腺瘤

解析：甲状腺腺瘤，如甲状腺高功能腺瘤（D对），有引起甲亢和恶变的可能，所以其治疗原则是早期行包括患侧的甲状腺腺叶或部分（腺瘤小）切除。甲状腺乳头状癌（A错）根据病变情况选择一侧甲状腺加峡部切除或全甲状腺切除，根据淋巴结转移情况选择中央淋巴结清扫或颈部淋巴结清扫。不主张行甲状腺肿瘤摘除或甲状腺次全切除。而甲亢手术的禁忌症之一是青少年病人，所以青少年原发性甲亢（B错）不宜手术。单纯性弥漫性甲状腺肿（C错）根据病因采取不同治疗，而符合手术指征的多采取甲状腺次全切除术。桥本病（E错）的治疗可长期用左甲状腺素或甲状腺素片。有压迫症状者、疑有恶变者可考虑手术。